某女，25岁，妊娠6周，阴道少量出血，血色鲜红，伴眩晕心悸，证属血虚之胎动不安，宜选用的药是
A. 砂仁
B. 阿胶
C. 当归
D. 杜仲
E. 黄芩

正确答案：B。阿胶

解析：本题考查的是阿胶的主治病证。妊娠6周，阴道少量出血，血色鲜红，伴眩晕心悸，证属血虚之胎动不安，宜选用的药是阿胶（B对）。阿胶：【主治病证】（1）血虚眩晕、心悸。（2）吐血，衄血，便血，崩漏，妊娠胎漏。（3）阴虚燥咳或虚劳喘咳。（4）阴虚心烦、失眠。砂仁（A错）：【主治病证】（1）湿阻中焦证。（2）脾胃气滞证。（3）脾胃虚寒之吐泻。（4）妊娠恶阻，气滞之胎动不安。当归（C错）：【主治病证】（1）血虚萎黄、眩晕心悸。（2）月经不调，闭经，痛经。（3）虚寒腹痛，瘀血作痛，跌打损伤，痹痛麻木。（4）痈疽疮疡。（5）血虚肠燥便秘。杜仲（D错）：【主治病证】（1）肝肾不足之腰膝酸痛、筋骨无力。（2）肝肾亏虚之胎动不安、胎漏下血。（3）高血压属肝肾亏虚者。黄芩（E错）：【主治病证】（1）湿温，暑湿，湿热胸闷、黄疸、泻痢、淋痛、疮疹。（2）热病烦渴，肺热咳喘，少阳寒热，咽痛，目赤，火毒痈肿。（3）血热之吐血、咳血、衄血、便血、崩漏。（4）胎热之胎动不安。